锯鳞蝰蛇毒
A. 启动内源性凝血系统
B. 启动外源性凝血系统
C. 两者都是
D. 两者都不是
E. 无

正确答案：D。两者都不是

解析：锯鳞蝰蛇毒可直接将凝血酶原变为凝血酶，属于促凝物质进入血液（D对ABCE错）。